当右心室收缩时，防止右心室内的血液逆流的装置是
A. 二尖瓣
B. 三尖瓣
C. 主动脉瓣和二尖瓣
D. 肺动脉瓣和三尖瓣
E. 主动脉瓣和肺动脉瓣

正确答案：B。三尖瓣

解析：当右心室收缩时，三尖瓣（B对）紧闭，因乳头肌收缩和腱索牵拉，使瓣膜不致翻向心房，为防止右心室内的血液逆流的装置。